手少阴心经的络穴是
A. 少海
B. 神门
C. 阴郄
D. 通里
E. 灵道

正确答案：D。通里

解析：络穴是联络表里两经的腧穴，具有加强表里两经的作用。手少阴心经的络穴是通里（D对）；少海是心经合穴（A错）；神门是心经原穴（B错）；阴郄是心经郄穴（C错）；灵道是心经经穴（E错）。